蜈蚣所含的有毒成分之一是
A. 溶血蛋白质
B. 角蛋白
C. 氨基酸
D. 脂肪油
E. 胆甾酸

正确答案：A。溶血蛋白质

解析：本题考查的是蜈蚣的成分。蜈蚣所含的有毒成分之一是溶血蛋白质（A对）。蜈蚣【成分】含两种类似蜂毒的有毒成分，即组胺样物质及溶血蛋白质。此外，尚含酪氨酸、亮氨酸、蚁酸、脂肪油、胆甾酸（E错）、半胱氨酸家族毒素等。羚羊角【成分】含角蛋白（B错）、磷酸钙及不溶性无机盐等。羚羊角经酸水解后测定，含异白氨酸、白氨酸、苯丙氨酸、酪氨酸、丙氨酸等多种氨基酸（C错）。松花粉【成分】主要含脂肪油（D错）和色素。并有甾醇及黄酮类成分。